以解表祛湿清里为主要功用的方剂是
A. 麻杏石甘汤
B. 桂枝汤
C. 大青龙汤
D. 柴葛解肌汤
E. 九味羌活汤

正确答案：E。九味羌活汤

解析：九味羌活汤方含羌活、防风、苍术、细辛、川芎、白芷，可散风寒、祛湿；生地黄、黄芩，可清里热，故九味羌活汤以解表祛湿清里为主要功用（E对）。麻杏石甘汤以辛凉疏表，清肺平喘为功用（A错）。桂枝汤以解肌发表，调和营卫为功用（B错）。大青龙汤以发汗解表，兼清里热为功用（C错）。柴葛解肌汤以解肌清热为功用（D错）。